龈下刮治术中，下列操作不正确的是
A. 以改良握笔式握持器械
B. 支点稳妥
C. 匙形器放入牙周袋时使工作端平面与牙根面平行
D. 匙形器探到牙石根方后，与牙面形成80°角进行刮治
E. 匙形器放入牙周袋时使工作端平面与牙根面成80°角

正确答案：E。匙形器放入牙周袋时使工作端平面与牙根面成80°角

解析：匙形器放入牙周袋时应使工作端平面与牙根面平行，到达袋底后，与根面间逐渐成45°角，以探查根面牙石，探到牙石根方后，与牙面形成80°角进行刮治，操作完成后仍回到与根面平行的位置，取出器械。掌握“慢性牙周炎的治疗原则、程序及方法”知识点。